36周产女婴，出生后反应好，体检其指甲外观特点是
A. 指甲硬
B. 反甲
C. 甲面多白纹
D. 指甲未达指尖
E. 指甲超过指尖

正确答案：D。指甲未达指尖

解析：题干中36周产女婴为早产儿，故由（P89）表7-2可知：指（趾）甲未达指（趾）末端（D对）是其体检时指甲外观特点，而指（趾）甲达到或超过指（趾）末端（E错）则是足月儿的特点之一。其中反甲（B错）是一种指（趾）甲板畸形，多见于缺铁性贫血、高原疾病，偶见于真菌感染的甲藓及风湿热。指甲硬（A错）及甲面多白纹（C错）均不是早产儿的特点。